提出“治外必本于内”思想的专著是
A. 《外科正宗》
B. 《外科理例》
C. 《外科启玄》
D. 《外台秘要》
E. 《诸病源候论》

正确答案：B。《外科理例》

解析：《外科正宗》内容丰富，条理清晰，主张应用外治法和进行外科手术（A错）。《外科理例》有外科必本于内，知乎内，以求乎外提出了治外必本诸内的思想（B对）。《外科启玄》论述外科各病证治，有图有方，叙述内服外敷，针灸灸烙、熏点、刀割等法（C错）。《外台秘要》汇集了初唐及唐以前的医学著作，外科方面对瘿瘤、痈疽等有记载  （D错）。《诸病源候论》对外科疾病包过40余种皮肤病的病因病理进行了阐述（E错）。